通过选择性作用于M胆碱受体，引起缩瞳，进而使房水回流并降低眼压的药物是
A. 卡替洛尔
B. 溴莫尼定
C. 毛果芸香碱
D. 布林佐胺
E. 拉坦前列素

正确答案：C。毛果芸香碱

解析：本题考查毛果芸香碱的作用机制。毛果芸香碱（C对）选择性直接作用于M胆碱受体，引起缩瞳，可降低眼压，用于治疗原发性青光眼。